外源性感染慢性患者
A. 病程≥1个月
B. 病程≥3个月
C. 病程≥6个月
D. 病程≥9个月
E. 病程≥12个月

正确答案：C。病程≥6个月

解析：外源性感染指来自宿主体外细菌的感染，包括急性或慢性患者，带菌者以及病畜和带菌动物，均可向外环境排出病原菌。急性或慢性患者：系细菌显性感染机体，有明显临床症状体征者。根据病程分为急性患者与慢性患者，一般≥6个月病程者，称为慢性患者。掌握“宿主的抗菌免疫及感染的发生发展”知识点。